刺激小肠粘膜释放促胰液素的作用最强的物质是
A. 盐酸
B. 蛋白质分解产物
C. 脂酸钠
D. 脂肪
E. 糖类

正确答案：A。盐酸

解析：促胰液素是小肠上部黏膜的S细胞分泌的，具有刺激胰液和胆汁在HCO₃⁻的分泌，抑制胃酸分泌和胃肠运动的作用。盐酸是刺激促胰液素分泌的最强物质（A对），其次是蛋白质分解产物（B错）、脂酸钠（C错）、脂肪（D错）。糖类（E错）几乎没有刺激作用。